医生告知糖尿病患者坚持吃药，多运动，注意饮食，属于
A. 第一级预防
B. 第二级预防
C. 第三级预防
D. 第四级预防
E. 以上均错

正确答案：C。第三级预防

解析：本题考查糖尿病的分级预防。医生告知糖尿病患者坚持吃药，多运动，注意饮食，属于第三级预防（C对）。糖尿病的分级预防：一级预防（A错）：1.学习糖尿病的相关知识和技能。2.保持健康的生活方式，如：合理饮食、适量运动、戒烟限酒、心理平衡。3.积极发现和控制糖尿病的危险因素，如：高血压、高血脂等。4.避免或少用对糖代谢不利的药物。5.糖尿病的高危人群（如空腹血糖受损、糖耐量低减人群）应定期进行糖尿病筛查，并增加机会性筛查，除常规空腹血糖外，应重视餐后2小时血糖测定。二级预防（B错）：早发现、早诊断、早治疗，糖尿病病人应进行正规的糖尿病治疗，尽早和尽可能的控制好患者的血糖、血压，纠正血脂紊乱和肥胖，预防糖尿病并发症的发生。三级预防：控制好血糖、血压、血脂，提倡健康的生活方式，选择科学的治疗方法，遵循医嘱，减少糖尿病并发症的残废率和死亡率。